股骨易骨折的部位
A. 股骨颈
B. 转子间线
C. 粗线
D. 股骨体
E. 外侧踝

正确答案：A。股骨颈

解析：股骨颈狭细，易骨折（A对）。